有抗胆碱作用和阻断α受体的抗心律失常药物是
A. 奎尼丁
B. 普萘洛尔
C. 利多卡因
D. 维拉帕米
E. 苯妥英钠

正确答案：A。奎尼丁